薄壁细胞中含橙皮苷结晶的药材是
A. 麻黄
B. 薄荷
C. 穿心莲
D. 淫羊藿
E. 广藿香

正确答案：B。薄荷

解析：本题考查的是薄荷的显微鉴别。薄壁细胞中含橙皮苷结晶的药材是薄荷（B对）。薄荷【显微鉴别】叶横切面：①上表皮细胞呈方形，下表皮细胞细小扁平，均被角质层，有气孔；上下表皮凹陷处有腺鳞。②栅栏组织通常为1列细胞。③海绵组织为4～5列细胞。主脉上下表皮内方有厚角组织及薄壁组织。④主脉维管束外韧型，木质部导管常2～6个排列成行，韧皮部细胞细小。⑤表皮细胞、叶肉细胞、薄壁细胞及导管中有时含有橙皮苷结晶。麻黄（A错）【显微鉴别】粉末麻黄、蜜麻黄：气孔特异，内陷，保卫细胞侧面观呈哑铃状。纤维多而壁厚，附有小晶体（砂晶和方晶）。角质层极厚，呈脊状突起。穿心莲（C错）【显微鉴别】粉末上下表皮均有增大的晶细胞，内含大型螺状钟乳体，较大端有脐样点痕，层纹波状。下表皮气孔直轴式，副卫细胞大小悬殊，少数为不定式。另有腺鳞和非腺毛。淫羊藿（D错）【显微鉴别】叶表面：上、下表皮细胞垂周壁深波状弯曲，沿叶脉均有异细胞纵向排列，内含1至多个草酸钙柱晶；下表皮气孔众多，不定式，有时可见非腺毛。。广藿香（E错）【显微鉴别】叶片粉末：淡棕色。非腺毛1～6细胞，平直或先端弯曲，长约至590㎛，壁具刺状突起，有的胞腔含黄棕色物质。叶表皮细胞不规则形，气孔直轴式，副卫细胞清晰可见。腺鳞头部扁球形，由8个细胞组成，直径37～70㎛，柄单细胞，极短。小腺毛头部2细胞，柄1～3细胞，甚短。草酸钙针晶细小，散在于叶肉细胞中，长约至27㎛。间隙腺毛存在于栅栏组织或薄壁组织的细胞间隙中，头部单细胞，呈不规则囊状，直径13～50㎛，长约至113㎛，柄短，单细胞。